“健康就是没病”，这是人们对健康的
A. 错误的认识
B. 最初的认识
C. 正确的认识
D. 最佳状态
E. 以上说法均正确

正确答案：B。最初的认识

解析：“健康就是没病”，这是人们对健康的最初的认识。掌握“心理健康概述”知识点。